具有收敛邪气的药味
A. 辛味
B. 甘味
C. 酸味
D. 咸味
E. 苦味

正确答案：C。酸味

解析：本题考查酸味所示效用及临床应用。具有收敛邪气的药味酸味（C对）。酸能收、能涩，有收敛固涩作用。如治自汗盗汗、遗精滑精的五味子，治久泻久痢的五倍子，治久咳的乌梅，治大汗虚脱、崩漏经多的山茱萸等，均具酸味。另外，酸能生津、安蛔，如木瓜、乌梅等。酸味药大多能收敛邪气，凡邪未尽之证均当慎用。辛味（A错）能散、能行，有发散、行气、活血作用。如治表证的荆芥、薄荷，治气滞的香附，治血瘀的川芎等，都具有辛味。辛味药大多能耗气伤阴，气虚阴亏者慎用。甘味（B错）能补、能缓、能和，有补虚、和中、缓急、调和药性等作用。某些甘味药还能解药、食毒，如甘草、蜂蜜等。此外，甘味药多质润而善于滋燥。甘味药大多能腻膈碍胃，令人中满，凡湿阻、食积、中满气滞者慎用。咸味（D错）能软、能下，有软坚散结、泻下通便作用，如治瘰疬、痰核的昆布、海藻，治癥瘕的鳖甲，治热结便秘的芒硝等，均具咸味。有的咸味药如芒硝，能泻下通肠，脾虚便溏者慎用。苦味（E错）能泄、能燥、能坚。其中，能泄的含义有三：一指苦能通泄，如大黄苦寒，功能泻热通便，治热结便秘每用。二指苦能降泄，如苦杏仁味苦降泄肺气，治咳喘气逆必投；代赭石味苦而善降逆，治呃逆呕喘常选。三指苦能清泄，如黄连、栀子味苦，能清热泻火，治火热内蕴或上攻诸证宜择。能燥即指苦能燥湿，如治寒湿的苍术、厚朴，治湿热的黄柏、苦参等，均为苦味。能坚的含义有二：一指苦能坚阴，意即泻火存阴，如黄柏、知母即是；二指坚厚肠胃，如投用少量苦味的黄连，有厚肠止泻的作用等。苦味药大多能伤津、伐胃，津液大伤及脾胃虚弱者不宜大量用。